下列关于ANUG的主要临床表现，说法错误的是
A. 主要特征性损害为龈乳头和边缘龈的坏死
B. 病程较短，一般为数天至1～2周
C. 病变往往仅累及附着龈
D. 疼痛明显
E. 有腐败性口臭

正确答案：C。病变往往仅累及附着龈

解析：本题考查急性坏死性溃疡性龈炎的临床表现。下列关于ANUG的主要临床表现，说法错误的是病变往往仅累及附着龈（C错，为本题的正确答案）。急性坏死性溃疡性龈炎（ANUG）是指发生于龈缘和龈乳头的急性炎症和坏死，好发于青壮年，以男性吸烟者多见，本病起病急，病程较短，常为数天至1～2周（B对）。病变的主要特征性损害为龈乳头和边缘龈的坏死（A对），尤以下前牙多见。龈乳头中央凹下如火山口状，龈缘如虫蚀状，坏死区可出现灰褐色假膜，龈乳头被破坏后与龈缘成一直线，如刀切状，病变往往不累及附着龈。患处牙龈极易出血，患者常诉疼痛明显（D对），由于组织的坏死，常有腐败性口臭（E对）。轻症患者一般无明显的全身症状，重症患者可有低热、疲乏等全身症状，部分患者下颌下淋巴结可肿大，有压痛。